材料三，在一个研讨班上，学员对假劣药情形、使用法律和法律责任展开了讨论。讨论的情形主要包括四个，一是采用多加矫味剂生产儿童退热药；二是多加药用淀粉少用主药生产降压药；三是部分药品超过有效期；四是某抗菌药物的外包装上标示的适应症与批准的药品说明书中适应症表述不一致，其外包装上添加了可以作为前列腺炎的二线用药的适应症等。上述信息中所指的四种情形，应按假药或者假药论处的是
A. 多加矫味剂生产儿童退热药
B. 多加药用淀粉生产降压药
C. 药品超过有效期
D. 外包装上标示的适应症超过批准的说明书内容的

正确答案：D。外包装上标示的适应症超过批准的说明书内容的

解析：本题考查假药的界定。应按假药或者假药论处的是外包装上标示的适应症超过批准的说明书内容的（D对）。假药的界定：《药品管理法》第九十八条第一款、第二款规定，禁止生产（包括配制，下同）、销售、使用假药。有下列情形之一的，为假药：①药品所含成分与国家药品标准规定的成分不符；②以非药品冒充药品或者以他种药品冒充此种药品；③变质的药品；④药品所标明的适应症或者功能主治超出规定范围。劣药的界定：根据《药品管理法》第九十八条第三款规定，有下列情形之一的，为劣药：①药品成分的含量不符合国家药品标准（B错）；②被污染的药品；③未标明或者更改有效期的药品；④未注明或者更改产品批号的药品；⑤超过有效期的药品（C错）；⑥擅自添加防腐剂、辅料的药品（A错）；⑦其他不符合药品标准的药品。